长期应用地西泮须加大剂量才产生原有的催眠效果，这是产生了
A. 耐受性
B. 成瘾性
C. 反跳现象
D. 戒断症状
E. 急性中毒

正确答案：A。耐受性

解析：耐受性是指同一药物连续使用过程中，会出现药效逐渐减弱，需加大剂量才能产生相同的药效；苯二氮䓬类药物长期使用可产生耐受性；长期应用地西泮须加大剂量才产生原有的催眠效果，这是产生了耐受性（A对）。